实验中，夹闭兔双侧颈总动脉后全身血压升高，心率加快，主要原因是
A. 颈动脉窦受到牵张刺激
B. 颈动脉窦受到缺氧刺激
C. 主动脉弓受到牵张刺激
D. 主动脉神经传入冲动减少
E. 颈动脉窦神经传入冲动减少

正确答案：E。颈动脉窦神经传入冲动减少